《经脉别论》所述“毛脉合精”是指
A. 气血相合
B. 经脉经别相合
C. 细小络脉相合
D. 毛脉均受谷气
E. 毛脉相会和

正确答案：A。气血相合

解析：肺主气外合皮毛，心主血脉，毛脉合精，即气血相合（A对）。张志聪注：“夫皮肤主气，经脉主血，毛脉合精者，血气相合也。”